安全用水百分率、计划免疫覆盖率属于
A. 卫生政策指标
B. 社会经济指标
C. 预防性卫生服务指标
D. 健康状况指标
E. 其他

正确答案：C。预防性卫生服务指标